龈上洁治术中哪项不必要
A. 支点稳定
B. 刀刃与牙面成80°角
C. 调整好体位
D. 仔细探查牙面的位置
E. 使用手指和手腕的动作

正确答案：D。仔细探查牙面的位置

解析：本题考查龈上洁治术。龈上洁治术中不必仔细探查牙面的位置（D错，为本题正确答案），主要是探查附着在牙面上的牙石。操作前应首先调整好患者的体位（C对）。只有放稳支点和正确地握持器械，才能在洁治用力的过程中始终保持力的稳定（A对），刀刃与牙面成80°角左右（B对），握持器械的方法为改良握笔法，同时以中指或中指加无名指放于被洁治牙附近的牙作为支点，以腕部（E对）发力刮除牙石。